现已被公认诊断支气管扩张的主要方法是
A. 肺功能
B. 支气管造影
C. 肺组织病理
D. 支气管镜
E. HRCT

正确答案：E。HRCT

解析：HRCT（高分辨CT）（E对）不仅可在横断面上清楚显示病变，且无创、易重复、易接受，已成为支气管扩张的主要诊断方法。肺功能（A错）检查并不能确诊病因，多用于对于早期检出肺、气道病变，评估疾病的病情严重程度及预后，评定药物或其它治疗方法的疗效，评估肺功能对手术的耐受力或劳动强度耐受力等方面有重要的指导意义。支气管造影（B错）为过去的确诊支气管扩张的方法，现已被高分辨CT（HRCT）所取代。肺组织病理（C错）取病变组织难度大且对机体创伤也大，效果不如HRCT。支气管镜（D错）仅可发现位于段支气管以上的病变。